川芎的主治病证是
A. 胸痹心痛
B. 小便不利
C. 痛经经闭
D. 风湿痹痛
E. 头痛

正确答案：A、C、D、E。胸痹心痛；痛经经闭；风湿痹痛；头痛

解析：本题考查的是川芎的主治病证。川芎的主治病证是胸痹心痛（A对）、痛经经闭（C对）、风湿痹痛（D对）与头痛（E对）。川芎：【主治病证】（1）月经不调，痛经，闭经，难产，产后瘀阻腹痛。（2）胸痹心痛，胁肋作痛，肢体麻木，跌打损伤，疮痈肿痛。（3）头痛，风湿痹痛。益母草：【主治病证】（1）月经不调，痛经，闭经，产后瘀阻腹痛，跌打伤痛。（2）小便不利（B错），水肿。（3）疮痈肿毒，皮肤痒疹。